患者，男，50岁。患风湿病多年，2周前突发小腿肌肉抽搐（腓肠肌痉挛），近几天发作频繁，尤以劳累及受凉后症状加重。治疗应首选
A. 独活
B. 五加皮
C. 木瓜
D. 羌活
E. 防己

正确答案：C。木瓜

解析：患者患风湿多年，2周前突发小腿肌肉抽搐（腓肠肌痉挛），近几天发作频繁，尤以劳累及受凉后症状加重，为湿邪致病，出现的湿痹。木瓜味酸入肝，善于舒筋活络，且能祛湿除痹，为湿痹拘挛要药（C对）。独活（A错）的功效是祛风除湿，通痹止痛，解表。五加皮（B错）的功效是祛风除湿，补益肝肾，强健筋骨。羌活（D错）的功效是解表散寒，祛风除湿，止痛。防己（E错）的功效是祛风止痛，利水消肿。